治风湿痹痛、腰膝酸软，常以独活配
A. 防风
B. 桑枝
C. 丝瓜络
D. 桑寄生
E. 海风藤

正确答案：D。桑寄生

解析：本题考查的是桑寄生的配伍。治风湿痹痛、腰膝酸软，常以独活配桑寄生（D对）。桑寄生：【配伍】桑寄生配独活：桑寄生性平，既能祛风湿，又能强筋骨；独活性温，功能散风寒湿止痛。两药相配，既祛风寒湿，又强腰膝，治风湿痹痛、腰膝酸软者可投。防风（A错）、桑枝（B错）、丝瓜络（C错）、海风藤（E错）的配伍，2022年考试指南未明确说明。